属于受体信号转导第二信使的有
A. 环磷酸腺苷（cAMP）
B. 环磷酸鸟苷（cGMP）
C. 钙离子（Ca²⁺）
D. 一氧化氮（NO）
E. 乙酰胆碱（Ach）

正确答案：A、B、C、D。环磷酸腺苷（cAMP）；环磷酸鸟苷（cGMP）；钙离子（Ca²⁺）；一氧化氮（NO）

解析：本题考查受体作用的信号转导。第二信使为第一信使作用于靶细胞后在胞质内产生的信息分子。第二信使包括环磷酸腺苷（cAMP）（A对）、环磷酸鸟苷（cGMP）（B对）、IP₃、DAG、PGs、Ca²⁺（C对）、廿碳烯酸类、一氧化氮（NO）（D对）等。乙酰胆碱（Ach）（E错）是第一信使。